增加心肌收缩功能的药物是
A. 钙拮抗剂
B. 硝酸甘油
C. 多巴胺
D. β受体阻断剂
E. 利尿剂

正确答案：C。多巴胺

解析：高浓度的多巴胺（C对）可作用于心脏β1受体，增强心肌收缩功能。钙拮抗剂（A错）通过使心肌细胞Ca2+内流减少、β受体阻断剂（D错）通过阻断心脏β受体，拮抗儿茶酚胺对心脏的正性作用来减弱心肌收缩功能。硝酸甘油（B错）通过扩张静脉使回心血量减少、利尿剂（E错）通过促进水钠排泄来减轻心脏前负荷，无增强心肌收缩功能。